距小腿关节
A. 又称为距跟关节
B. 四周均有韧带加强
C. 内侧韧带又称为三角韧带
D. 能做屈伸、收展运动
E. 由胫骨下端和跖骨滑车构成

正确答案：C。内侧韧带又称为三角韧带

解析：距小腿关节又称为踝关节（A错），由胫、腓骨的下端与距骨滑车构成（E错），关节囊前后壁薄而松弛，两侧有韧带加强（B错），内侧有内侧韧带（又称为三角韧带）（C对）加强，仅能做屈伸运动（D错）。